患者，男，35岁。大面积烧伤合并严重绿脓杆菌感染，生化检查血肌酐及尿素氮值异常。应选用的抗感染药物是
A. 复方新诺明
B. 头孢氨苄
C. 头孢三嗪
D. 庆大霉素
E. 丁胺卡那霉素

正确答案：C。头孢三嗪

解析：头孢三嗪又名头孢曲松，对革兰氏阴性菌如肠杆菌类、厌氧菌以及绿脓杆菌有较好的作用，对多种β-内酰胺酶稳定，并且对肾脏几乎无毒，常用于治疗耐药金黄色葡萄球菌、耐氨苄青霉素的流感杆菌，耐第一代头孢菌素和庆大霉素的一些革兰氏阴性菌如绿脓杆菌等引起的感染，该患者绿脓杆菌感染合并肾功能损伤，适宜选用头孢三嗪（C对）。复方新诺明（A错）抗菌作用增强，耐药菌株减少，临床主要用于大肠埃希菌、克雷伯菌属、肠杆菌属、奇异变形杆菌、普通变形杆菌等所致的尿路感染，肺炎链球菌或流感嗜血杆菌所致的急性中耳炎以及成人慢性支气管炎急性发作等，不用于绿脓杆菌感染。头孢氨苄（B错）对青霉素酶稳定，但对肾脏有一定毒性，对金黄色葡萄球菌、溶血性链球菌、肺炎杆菌作用强，对绿脓杆菌作用较弱，临床主要用于敏感菌所引起的呼吸道、泌尿道、皮肤、软组织等感染。庆大霉素（D错）抗菌谱广，抗菌活性强，是治疗各种革兰氏阴性杆菌感染的主要抗菌药，尤其对沙雷菌属作用更强，临床用于败血症、脑膜炎、骨髓炎、肺炎、泌尿道感染、胆道感染、烧伤感染等，铜绿假单胞菌感染常与羧苄西林合用。卡那霉素（E错）抗菌谱与链霉素类似，对结核杆菌作用稍强，对铜绿假单胞菌无效，临床主要口服用于肠道术前消毒。